明确胰腺癌首选的检查方法是
A. MRI
B. B超检查
C. CT
D. X线气钡双重造影
E. 血尿淀粉酶测定

正确答案：C。CT

解析：胰腺癌首选的检查方法是CT（C对），胰腺动态薄层增强扫描及三维重建检查对于胰腺肿瘤的定性、定位诊断提供非常重要的影像学依据，尤其是对胰腺肿瘤的术前可切除性评估具有重要意义。单纯的MRI（A错）对胰腺癌的诊断不优于增强CT，而MRI价格较CT昂贵，一般不作首选检查。B超检查（B错）多用于胰腺疾病的普查和筛选。X线气钡双重造影（D错）主要用于胃肠道病变的诊断，对急性胰腺炎的诊断价值不大，一般不用。血、尿淀粉酶测定（E错）为急性胰腺炎的首选检查方法。